肝风内动表现是
A. 横目斜视
B. 昏睡露睛
C. 瞳孔散大
D. 目睛微定
E. 双睑下垂

正确答案：A。横目斜视

解析：固定侧视者，称横目斜视，属于肝风内动之征（A对）。昏睡露睛多见于脾胃虚衰或吐泻伤津的患者（B错）。瞳孔散大多属肾精耗竭，见于危重患者，是濒死前的征象之一，也见于肝胆风火上扰的绿风内障、中毒（如杏仁、麻黄、曼陀罗中毒）及某些西药（如阿托品）所致的药物性瞳孔散大等（C错）。肝风内动不会引起目睛微定（D错）。双眼上睑下垂者，多为先天禀赋不足，脾肾亏虚，睑肌失养所致（E错）。